维生素B₁₂主要用于
A. 双香豆素类过量引起的出血
B. 纤溶亢进所致的出血
C. 血栓性疾病
D. 恶性贫血和巨幼红细胞贫血
E. 肾性贫血

正确答案：D。恶性贫血和巨幼红细胞贫血

解析：本体考查维生素B₁₂的作用。巨幼红细胞性贫血（D对）一般是由于缺乏维生素B₁₂或叶酸引起的，应用维生素B₁₂治疗时需同时服用叶酸。双香豆素类过量引起的出血（A错）可用维生素K治疗。纤溶亢进所致的出血（B错）可用氨甲环酸治疗。血栓性疾病（C错）主要采用抗凝药、抗血小板药及溶栓药治疗。肾性贫血（E错）一般选用促红素治疗。